对繁殖期结核分枝杆菌有较强的抑制作用，但是对其他细菌无效的药物是
A. 血小板
B. 华法林
C. 四环素
D. 青霉素
E. 乙胺丁醇

正确答案：E。乙胺丁醇

解析：乙胺丁醇对繁殖期结核分枝杆菌有较强的抑制作用，对其他细菌无效。掌握“异烟肼、利福平及乙胺丁醇”知识点。